下列有关畸形中央尖的防治说法正确的是
A. 圆钝和咬合接触无碍的畸形中央尖可不处理
B. 对刚萌出的牙齿上细而尖的中央尖加固防折
C. 如果已发生牙髓感染，须做牙髓治疗
D. 牙根形成过少而又发生根尖周围严重感染的患牙则拔除
E. 以上说法均正确

正确答案：E。以上说法均正确

解析：畸形中央尖的防治：①圆钝和咬合接触无碍的畸形中央尖可不处理而进行观察。②对刚萌出的牙齿上细而尖的中央尖加固防折。为防止其日后折断感染，可用强粘接剂和复合树脂在中央尖周围加固，使畸形尖随着牙齿一同发生生理磨损，促使髓角处形成继发性牙本质，牙髓和牙根发育保持正常。③如果已发生牙髓感染，须做牙髓治疗：年轻恒牙应首先考虑采用根尖诱导成形术，待牙根发育形成之后，再做完善的根管治疗。④牙根形成过少而又发生根尖周围严重感染的患牙，或根尖周病变与龈沟相通者，则拔除。掌握“畸形中央尖”知识点。